楔状缺损的病因包括
A. 横刷牙
B. 酸性龈沟液
C. 牙体应力疲劳
D. 颈部结构的薄弱
E. 以上都是

正确答案：E。以上都是

解析：本题考查楔状缺损的病因。楔状缺损的病因包括：横刷牙（A对）、酸性龈沟液（B对）、牙体应力疲劳（C对）、颈部结构的薄弱（D对）。（ABCD均对，故E为本题的正确答案）。